通过交谈或问卷的方法了解一些人对某一事件的感受、态度和行为，在医学心理学的研究方法中属于
A. 调查法
B. 临床观察法
C. 个案法
D. 实验法
E. 心理测验法

正确答案：A。调查法

解析：调查的含义是当有些资料不可能从当事人那里获得时，就要从相关的人或材料那里得到。因此，调查是一种间接的、迂回的方式。当然，有些资料即便可以从当事人那里获得，但可信度如何，所以也需要再进行调查以便印证资料的可信程度。现状调查主要围绕与当前问题有关的内容进行，如在现实生活中的表现如何，适应能力的水准等，以与当事人关系密切的人（如同学、同事、父母、亲友、老师、领导、兄弟姐妹等）为调查重点。掌握“心理评估概述”知识点。